治疗缓慢性心律失常气阴两虚证，应首选
A. 桃仁红花煎
B. 黄连阿胶汤
C. 导痰汤
D. 炙甘草汤
E. 十味温胆汤

正确答案：D。炙甘草汤

解析：缓慢性心律失常气阴两虚证的病机为心气虚，鼓动无力；心阴虚，心脉失养，故以心悸，气短，乏力，失眠多梦，自汗盗汗，五心烦热为主症，故其治法为益气养阴，养心通脉，方药首选益气养阴通脉的炙甘草汤（D对）加减。桃仁红花煎（A错）功效可活血化瘀定悸，用于治疗瘀血阻滞证。黄连阿胶汤（B错）可滋阴降火安神，用于治疗心肾不足，阴虚火旺的心烦失眠。导痰汤（C错）可燥湿化痰，行气开郁，用于治疗痰阻气滞证。十味温胆汤（E错）可理气化痰，清胆和胃，用于治疗胆胃不和，痰热内扰证。